多形性低度恶性腺癌肿瘤细胞主要由哪些细胞构成
A. 腺上皮、肌上皮、软骨样组织
B. 肿瘤性肌上皮细胞和肿瘤性导管上皮细胞
C. 嗜伊红颗粒的大嗜酸性粒细胞
D. 腺泡样细胞、闰管样细胞、空泡样细胞、透明细胞
E. 黏液细胞、表皮样细胞和中间细胞

正确答案：B。肿瘤性肌上皮细胞和肿瘤性导管上皮细胞

解析：多形性低度恶性腺癌肿瘤细胞主要由肿瘤性肌上皮细胞和肿瘤性导管上皮细胞构成。掌握“多形性低度恶性腺癌”知识点。